1岁以内婴儿基础代谢，每日每公斤约需
A. 80 kcal
B. 66 kcal
C. 55 kcal
D. 44 kcal
E. 30 kcal

正确答案：C。55 kcal

解析：小儿基础代谢率的能量需要较成年人高，随着年龄增长逐渐减少。1岁以内婴儿的基础能量需求为55kcal／kg（C对）。